婴儿期计划免疫，正确的接种时间是
A. 脊髓灰质炎疫苗2个月以上
B. 卡介苗2～3个月
C. 麻疹疫苗4～5个月
D. 牛痘6～8个月
E. 乙型脑炎疫苗9～10个月

正确答案：A。脊髓灰质炎疫苗2个月以上

解析：婴儿期计划免疫，正确的接种时间是：脊髓灰质炎疫苗2个月以上（A对）、卡介苗出生时接种（B错）、麻疹疫苗8个月（C错）。1980年5月8日，在第33届世界卫生大会上宣布天花已在地球上灭绝。中国1982年后停止种牛痘疫苗工作（D错）。根据流行地区和季节，有时也进行乙型脑炎疫苗，时间是6个月到6周岁儿童（E错），不是需要接种的基础免疫。